非典型性增生是
A. 良性肿瘤
B. 恶性肿瘤
C. 交界性肿瘤
D. 癌前病变
E. 非肿瘤性良性病变

正确答案：D。癌前病变

解析：非典型性增生可见于肿瘤性病变也可见于非肿瘤性病变（ABCE错），描述细胞增生并出现异型性，提示有癌变的可能。而癌前病变本身不是恶性肿瘤，但具有发展为恶性肿瘤的潜能，两者阐述一致，因此非典型性增生属于癌前病变（D对）。